高中生从事轻、中度工农业劳动，其劳动负荷不应超过成人的
A. 0.25
B. 0.4
C. 0.6
D. 50%～60%
E. 70%～75%

正确答案：E。70%～75%